低钾血症对糖代谢的影响是
A. 减少胰岛素释放，增高血糖
B. 减少胰岛素释放，降低血糖
C. 增加胰岛素释放，增高血糖
D. 增加胰岛素释放，降低血糖
E. 无影响

正确答案：E。无影响

解析：过量胰岛素使用可促进细胞糖原合成，使细胞外钾随同葡萄糖转入细胞内而引起低钾血症。而低钾血症对胰岛素分泌无明显影响（E对）。